躯干、四肢意识性本体感觉传导通路的交叉部位
A. 颈髓
B. 胸髓
C. 延髓
D. 脑桥
E. 中脑

正确答案：C。延髓

解析：躯干、四肢意识性本体感觉传导通路第一级神经元为脊神经节，第二级神经元的胞体在薄束核和楔束核内，交叉后形成丘系交叉的部位在延髓（C对）。